医院感染的分类不包括
A. 自身感染
B. 医源性感染
C. 社区获得性感染
D. 带入感染
E. 交叉感染

正确答案：C。社区获得性感染

解析：医院感染可按病原体来源不同分为内源性医院感染和外源性医院感染两大类。
①内源性医院感染：又称自身医院感染，是患者遭受自身体内的病原菌侵袭发生的感染，病原体一般为寄居在患者体内的正常菌群，通常不致病，但在长期使用免疫抑制剂或激素致使机体免疫力降低，或长期使用抗生素，体内生态环境失衡引起的菌群失调或发生二重感染时出现内源性医院感染。
②外源性医院感染：包括交叉感染、环境感染、医源性感染，是指各种原因导致患者在医院内遭受非自身体内的病原菌侵袭而发生的感染，病原体来自于患者身体以外的个体、环境等。